喉部发生炎症、水肿时，产生吸气性呼吸困难的主要机制是
A. 吸气时气道内压低于大气压
B. 吸气时胸内压降低
C. 吸气时肺泡扩张压迫胸内气道
D. 小气道闭合
E. 等压点上移至小气道

正确答案：A。吸气时气道内压低于大气压

解析：喉部发生炎症、水肿时，产生吸气性呼吸困难的主要机制是吸气时气道内压低于大气压（A对）。